女，50岁，两小时前擦窗户从窗台坠落，会阴部皮肤感觉缺失，不能自主排便，双下肢感觉及运动正常，正常MRI示T₁₂椎体爆裂骨折，将突入椎管压迫脊髓，对其神经损伤诊断正确的是
A. 前脊髓综合征
B. 后脊髓综合征
C. 胸段脊髓震荡
D. 脊髓圆锥损伤
E. 马尾神经损伤

正确答案：D。脊髓圆锥损伤

解析：该患者女，50岁，两小时前擦窗户从窗台坠落，出现会阴部皮肤感觉缺失，不能自主排便，双下肢感觉及运动正常，结合患者的表现，是脊髓圆锥损伤（D对）。